医务人员与患者沟通时，适宜的方式是
A. 回避目光
B. 多用自我表露
C. 加快语速
D. 多用术语
E. 注意倾听

正确答案：E。注意倾听

解析：医患沟通的方法有选择正确的沟通形式、选择恰当的沟通场所、使用沟通技巧。常用的沟通技巧包括：（1）	尊重，接纳患者：不论患者的年龄、性别、身份与职业，用符合患者文化背景的方式表达对患者的尊重与接纳。对患者的称呼、躯体距离、姿势、恰当的目光接触（A错）等都体现对患者的尊重与接纳。（2）聆听与共情能力：耐心而认真地聆听患者的陈述（E对），对患者的陈述予以恰当的回应，表达理解，设身处地地体验到患者的病痛和疾苦并表达同感。（3）	明确的沟通目标，围绕沟通目标提问。（4）控制沟通中的信息：有效的沟通需要传递与沟通目标相关的信息，不要偏离了目标，提供与目标无关的信息（B错）。（5）把握沟通的语言、语调和语速：沟通中语言要简练、清晰，通俗、易于理解，不要充满医学术语让患者费解（D错）。对不同的对象，语言的速度、音量都应有所不同（C错）。对老人、虚弱的患者，要注意语速慢些，在患者注意力集中和保持目光接触的状态，以简练清晰的语言传递信息。（6）尽可能符合患者的文化背景。（7）确认彼此是否信任真诚。